口服剂型在胃肠道中吸收快慢的顺序一般认为是
A. 混悬剂＞溶液剂＞胶囊剂＞片剂＞包衣片
B. 胶囊剂＞混悬剂＞溶液剂＞片剂＞包衣片
C. 片剂＞包衣片＞胶囊剂＞混悬剂＞溶液剂
D. 溶液剂＞混悬剂＞胶囊剂＞片剂＞包衣片
E. 包衣片＞片剂＞胶囊剂＞混悬剂＞溶液剂

正确答案：D。溶液剂＞混悬剂＞胶囊剂＞片剂＞包衣片

解析：本题考查影响药物吸收的因素。口服剂型药物在胃肠道吸收顺序为溶液剂＞混悬剂＞胶囊剂＞片剂＞包衣片（D对）；口服溶液剂不存在药物释放问题，吸收最快；混悬剂分散度大，药物释放迅速；胶囊剂外壳崩解后药粉相当于散剂；包衣片相对于片剂要先溶解衣层，故吸收速度慢于片剂。